对稳定蛋白质构象通常不起作用的化学键是
A. 疏水键
B. 氢键
C. 酯键
D. 范德华力
E. 盐键

正确答案：C。酯键

解析：本题考查稳定蛋白质构象的化学键。酯键（C错，为本题的正确答案）常见于酸和碱脱水缩合反应后形成，主要存在于酯类物质，不存在于蛋白质中。维持蛋白质三级结构的稳定主要靠次级键如疏水键（A对）、盐键（E对）、氢键（B对）和范德华力（D对）等。